胸导管不收集的淋巴干是
A. 左、右腰干
B. 肠干
C. 左锁骨下干
D. 右锁骨下干
E. 左支气管纵隔干

正确答案：D。右锁骨下干

解析：左、右腰干（A对）、肠干（B对）、左锁骨下干（C对）、左支气管纵隔干（E对）均为胸导管收集的淋巴干。右锁骨下干（D错，为本题正确答案）为右淋巴导管收集的淋巴干。